男，38岁。间歇性上腹痛2年，受凉后加重，嗳气，近2天疼痛加重，突然呕血500ml，继而排黑便200ml，出血后腹痛缓解。其最可能的出血原因是
A. 胃癌
B. 慢性胃炎
C. 消化性溃疡
D. 急性胃黏膜病变
E. 食管静脉曲张破裂

正确答案：C。消化性溃疡

解析：患者青年男性，间歇性上腹痛2年（为慢性病程），有受凉后加重，嗳气症状。近2天疼痛加重（急性发病），突然呕血500ml，继而排黑便200ml，并有出血后腹痛缓解症状，根据患者病史和临床体征可诊断患者为消化性溃疡伴急性出血（C对）。80%早期胃癌无症状，溃疡性型胃癌出血时可引起呕血，黑便症状，肿瘤标志物（CEA、CA199、CA724）升高，有助于早期胃癌预警，可予胃镜活检鉴别（A错）。慢性胃炎常见于中年人，Hp感染为主要病因，大多数人无明显症状，可有上腹轻压痛，危重病应激被原发病掩盖，可导致上消化道出血症状（B错）。急性胃黏膜病变多为急性病程，多由于应激、服用药物、酒精、创伤和物理因素引起（D错）。食管静脉曲张破裂多由肝硬化门静脉压力增高引起。无出血后腹痛缓解症状（E错）。